初产妇，28岁，足月临产，宫口全开3小时，宫缩20秒/7-8min，枕左后，s+3，胎心监护：胎心基线平稳，胎心为150次/分，骨盆正位。目前情况如何处理
A. 手法逆时针90度旋转后产钳助产
B. 手法顺时针90度旋转后等候
C. 积极剖宫产
D. 静滴缩宫素
E. 密切监护，暂不做处理

正确答案：A。手法逆时针90度旋转后产钳助产

解析：初产妇，28岁，足月临产，宫口全开3小时，宫缩20秒/7-8min，枕左后，s+3（提示胎头已下降至坐骨棘平面以下3cm），胎心监护：胎心基线平稳，胎心为150次/分（正常胎心率基线110～160／分），骨盆正位，结合患者的表现， 手法逆时针90度旋转后产钳助产（A对）。